以下关于主动脉小球的说法，正确的是
A. 位于主动脉弓壁内
B. 位于主动脉弓前方
C. 位于主动脉弓上方
D. 位于主动脉弓下方
E. 属压力感受器

正确答案：D。位于主动脉弓下方

解析：位于主动脉弓下方（D对）靠近动脉韧带处有2～3个粟粒样的小体，为主动脉小球。